X线下见右上肺有多发的厚壁空洞，周围有较广泛的纤维条索影。应首先考虑的是
A. 肺大疱
B. 肺脓肿
C. 浸润型肺结核空洞形成
D. 慢性纤维空洞型肺结核
E. 周围型肺癌空洞形成

正确答案：D。慢性纤维空洞型肺结核

解析：X线下见右上肺有多发的厚壁空洞，周围有较广泛的纤维条索影，应首先考虑的是慢性纤维空洞型肺结核（D对）。肺大疱（A错）表现为位于肺野边缘细薄的透亮空腔，可为圆形、椭圆形或较扁的长方形，大小不一，较大的肺大疱中，有时可见到横贯的间隔。肺脓肿（B错）在急性化脓性炎症阶段，肺内出现大片密度致密影，密度较均匀，边缘模糊，可侵及一个肺段或一叶的大部，病变中心肺组织发生坏死液化后，则在致密的实变中出现含有液面的空洞。浸润型肺结核空洞形成（C错）X线表现：在肺上、中部显示大量条索状或以致密状影，其中有多发、不规则的空洞存在。周围型肺癌空洞形成（E错）X线表现：癌瘤发生坏死，与支气管相通排出后，可显示偏心性不规则空洞，如伴有感染可出现液平。